在某地区进行男性吸烟与膀胱癌关系的研究，得到如下资料：吸烟组膀胱癌发病率为50/10万，不吸烟组膀胱癌发病率为25/10万。该地区男性吸烟与膀胱癌关系的特异危险度为
A. 50
B. 25
C. 2
D. 0.5
E. 本资料不能计算

正确答案：B。25